被《本草纲目》誉为“气病之总司，女科之主帅”的药是
A. 木香
B. 陈皮
C. 香附
D. 乌药
E. 青皮

正确答案：C。香附

解析：香附辛散苦降，微甘能和，平而不偏。入肝经而善疏肝，入三焦经而善理气，故为疏肝理气之佳品，被李时珍《本草纲目》誉为“气病之总司，女科之主帅”（C对）。木香（A错）能通理三焦，尤善行肠胃气滞，兼健脾消食，为行气调中止痛之要药。陈皮（B错）既理气运脾而调中快膈，又燥湿理气而化痰浊，凡气滞、湿阻、痰壅之证即可投用，兼寒者最宜。乌药（D错）善行气、散寒、温肾、止痛，治三焦寒凝气滞诸痛及阳虚遗尿、尿频。青皮（E错）既善疏肝破气，治肝郁胁痛、乳房疾患、寒疝腹痛；又善散结消滞，治癥瘕积聚、久疟癖块及食积腹痛。